下列关于流感病毒特性的叙述，正确的是
A. 对冷敏感
B. 耐酸
C. 最适pH为9.0以上
D. 冷冻干燥后可长期保存
E. 对抗生素敏感

正确答案：D。冷冻干燥后可长期保存